对合并血栓高危的高血压患者，为进行一、二级预防提倡联合应用
A. 阿司匹林
B. 叶酸
C. 阿托伐他汀
D. 呋塞米
E. 布地奈德

正确答案：A。阿司匹林

解析：本题考查阿司匹林。阿司匹林（A对）不仅能够阻断前列腺素生物合成，也能抑制血小板凝聚，在外周动脉病的一、二级预防中非常重要。叶酸（B错）用于治疗由叶酸缺乏症引起的贫血。阿托伐他汀（C错）为HMG-CoA还原酶抑制剂类调血脂药。呋塞米（D错）为强效利尿药。布地奈德（E错）为糖皮质激素，用于哮喘的治疗。